必须具有质量检验机构的药事组织是
A. 药店
B. 药品零售连锁企业
C. 药品批发企业
D. 药品生产企业
E. 药品零售连锁、批发和生产企业

正确答案：D。药品生产企业

解析：本题考查药品生产企业。必须具有质量检验机构的药事组织是药品生产企业（D对）。开办药品生产企业应当符合以下条件：1.有依法经过资格认定的药学技术人员、工程技术人员及相应的技术工人，法定代表人、企业负责人、生产管理负责人（以下称生产负责人）、质量管理负责人（以下称质量负责人）、质量受权人及其他相关人员符合《药品管理法》《疫苗管理法》规定的条件。2.有与药品生产相适应的厂房、设施、设备和卫生环境。3.有能对所生产药品进行质量管理和质量检验的机构、人员。4.有能对所生产药品进行质量管理和质量检验的必要的仪器设备。5.有保证药品质量的规章制度，并符合药品生产质量管理规范要求。